职业病属于
A. 工伤
B. 职业性疾患
C. 职业性健康影响
D. 职业性病损
E. 职业中毒

正确答案：B。职业性疾患